关于神经症，正确的叙述是
A. 多有人格障碍
B. 多在强烈心理刺激下发病
C. 症状的特异性较差
D. 起病一般较急
E. 患者的社会功能不受影响

正确答案：C。症状的特异性较差

解析：神经症又名神经官能症，是一组精神障碍的总称，几乎可以发生在任何一种精神疾病和一些躯体疾病中，包括神经衰弱、强迫症、焦虚症、恐怖症、躯体形式障碍等等，特异性较差（C对）。神经症具有一定的人格特质基础但非人格障碍（A错）。神经症起病急，病程不足3个月或仅有一次短暂发作。社会功能相对良好，患者一般能适应社会，其行为一般保持在社会规范容许的范围内，可以为他人理解和接受，但其症状妨碍了患者的心理功能或社会功能（E错）。